积证气滞血阻型治疗应予
A. 失笑散
B. 逍遥散
C. 柴胡疏肝散合失笑散
D. 五积散
E. 化积丸

正确答案：C。柴胡疏肝散合失笑散

解析：气滞血阻之积证的病机是气滞血瘀，痹阻经脉，积而成块，治宜理气活血，消积散瘀，方选柴胡疏肝散合失笑散（C对）。